分子中含有8-氨基喹啉结构片段，在体内转化为具有较强氧化性的喹啉酸衍生物，用作防止疟疾复发和传播的抗疟药物是
A. 盐酸左旋咪唑
B. 阿苯达唑
C. 吡喹酮
D. 磷酸氯喹
E. 磷酸伯氨喹

正确答案：A。盐酸左旋咪唑

解析：本题考查盐酸左旋咪唑的结构。盐酸左旋咪唑（A对）分子中含有8-氨基喹啉结构片段，在体内转化为具有较强氧化性的喹啉酸衍生物，用作防止疟疾复发和传播。